定群研究，又称
A. 队列研究
B. 现况凋查
C. 病例对照调查
D. 临床随访研究
E. 实验研究

正确答案：A。队列研究

解析：队列研究（A对）是一种根据有无暴露某因素史分组的研究方法。现况调查（B错）（P047）是普查或抽样调查的方法收集一定的数据，并对数据分布特征加以描述的研究方式。病例对照研究（C错）（P059）则是根据是否患有某种待研究的疾病来分组的。临床随访试验（D错）（P078）在医疗机构中，收集某病患者的人口学资料、症状、体征、诊断试验结果、疾病诊断、治疗措施，直至治疗结束，利用数据评价各种临床干预措施对该患者的疗效。实验研究（E错）又称为流行病学试验，通过对比实验组和对照组的差别，从而判断实验因素的效果。